男性，28岁。患牙发木、浮出发胀1周。有轻微钝痛，咬紧患牙时疼痛有所改善。无冷热刺激激发痛。可能的诊断是
A. 急性浆液性根尖周炎早期
B. 急性浆液性牙髓炎早期
C. 急性化脓性根尖周炎早期
D. 急性化脓性牙髓炎早期
E. 急性牙周膜炎早期

正确答案：A。急性浆液性根尖周炎早期

解析：本题考查急性浆液性根尖周炎。男性，28岁。患牙发木、浮出发胀1周。有轻微钝痛，咬紧患牙时疼痛有所改善。无冷热刺激激发痛。可能的诊断是急性浆液性根尖周炎（A对）。患牙感发木、浮出，轻微钝痛，无冷热刺激激发痛，咬紧患牙疼痛减轻，患者的临床表现符合急性浆液性根尖周炎早期的病变特点，当病变继续发展，根尖周膜内压力升高，出现自发性、持续性的钝痛，咬合压力加重疼痛。急性浆液性牙髓炎早期（B错）主要特征为对温度敏感刺激，尤其是对冷刺激及酸甜刺激产生疼痛。急性化脓性根尖周炎早期（C错）表现为患牙出现自发性、剧烈持续的跳痛，伸长感加重，以致咬合时首先接触患牙并引起剧痛，患者因而不敢咬合。急性化脓性牙髓炎早期（D错）可表现为热痛冷缓解现象，即热刺激可产生剧痛，冷刺激可缓解疼痛。急性牙周膜炎早期（E错）表现为牙龈发炎肿胀，牙齿松动，无咬紧患牙疼痛缓解的现象。